污染物标准指数（PSI）超过200为
A. 显著危害水平
B. 紧急水平
C. 警报水平
D. 警戒水平
E. 大气质量标准水平

正确答案：C。警报水平

解析：本题考查污染物标准指数（PSI）的水平。污染物标准指数分为（PSI）100、200、300、400、500等界限面，分别代表以美国现行的大气质量标准、大气污染事件基准值（分为警戒、警报和紧急3级水平），以及显著危害等不同大气污染水平。PSI超过200为警报水平（C对ABDE错）。